医学心理学的研究对象为
A. 人类心理活动的规律
B. 人类行为的科学发展
C. 疾病发生发展的规律
D. 影响健康的有关心理问题和行为
E. 疾病预防和治疗的原则

正确答案：D。影响健康的有关心理问题和行为